5～17岁年龄组的人群的活动推荐量说法正确的是
A. 每周至少150分钟中等强度有氧体力活动
B. 每周至少1次高强度体力活动
C. 有氧活动每次至少持续10分钟
D. 每周至少完成150分钟低等强度有氧体力活动
E. 每天累计至少60分钟中等强度体力活动

正确答案：E。每天累计至少60分钟中等强度体力活动

解析：5～17岁儿童青少年应每天累计至少60分钟中等到高强度体力活动。掌握“身体活动促进”知识点。